与全口义齿固位有关的因素下列哪一项是错误的
A. 颌骨的解剖形态
B. 口腔黏膜的性质
C. 牙槽骨致密程度
D. 基托的伸展
E. 唾液的质和量

正确答案：C。牙槽骨致密程度

解析：本题考查影响全口义齿固位的有关因素。与全口义齿固位有关的因素错误的是牙槽骨致密程度（C错、为本题的正确答案）。根据固位原理，吸附力、大气压力等固位力作用的大小与基托面积大小成正比，颌骨的解剖形态（A对）直接影响基托面积，牙槽骨的致密程度不能影响基托面积的大小。口腔黏膜（B对）厚度适宜，有一定弹性和韧性，则基托组织面与黏膜易于密合；在不妨碍周围组织正常活动的情况下，基托边缘应尽量伸展（D对），对抗义齿脱位；唾液的黏稠度高、流动性小，可加强义齿固位（E对）。